MALT中B细胞产生IgA至黏膜表面为
A. 分泌型IgA
B. 排泄型IgA
C. 传导型IgA
D. 离散型IgA
E. 重组型IgA

正确答案：A。分泌型IgA

解析：黏膜相关淋巴组织（MALT）中B细胞分化为可以产生IgA的浆细胞，其经黏膜上皮细胞分泌至黏膜表面，称为分泌型IgA。掌握“黏膜免疫”知识点。